与胃痛关系最为密切的脏腑是
A. 肝、脾、胆
B. 肝、脾、胃
C. 肝、脾、肾
D. 肺、脾、胃
E. 肺、肝、胃

正确答案：B。肝、脾、胃

解析：胃气阻滞，胃失和降则发生胃痛，正所谓“不通则痛”，胃痛的病变部位在胃。肝胃之间，木克土，肝气郁结，易于横逆犯胃，以致中焦气机不通，发为胃痛。脾与胃同居中焦，互为表里，共主升降，故脾病多涉于胃（B对ACDE错）。